骨髓涂片细胞学检查的内容中，错误的是
A. 分数200个或500个有核细胞
B. 分数不同系列和不同发育阶段细胞
C. 计数粒红比例
D. 退化或破碎细胞在分数时应计入
E. 巨核细胞单独计数

正确答案：D。退化或破碎细胞在分数时应计入

解析：骨髓涂片细胞学检查包括分数不同系列和不同发育阶段的细胞，分数有核细胞，计数粒红比例，计数巨核细胞，不包括计数退化或破碎细胞。